蜜炙枇杷叶每100kg用炼蜜量为
A. 10kg
B. 12.5kg
C. 15kg
D. 20kg
E. 25kg

正确答案：D。20kg